包含有两个指数的是
A. 牙龈出血指数
B. CPI指数
C. 口腔卫生指数
D. 菌斑指数
E. 牙龈指数

正确答案：C。口腔卫生指数

解析：本题考查评价牙周健康的指数。包含有两个指数的是口腔卫生指数（C对）。口腔卫生指数里面有两个指数，分别是软垢指数（DI-S）和牙石指数（CI-S）。牙龈出血指数（A错）、 CPI指数（B错） 、菌斑指数（D错）、 牙龈指数（E错）均只有一个指数表示。